患儿自述有时弯腰可能引起牙齿疼痛，其X线根尖片显示髓腔内有阻射的钙化物，髓腔透射影区模糊。据此可以诊断为
A. 急性牙髓炎
B. 慢性溃疡性牙髓炎
C. 牙髓坏死
D. 牙髓钙化
E. 慢性增生性牙髓炎

正确答案：D。牙髓钙化

解析：牙髓钙化一般没有明显的临床症状，个别情况与体位相关的自发痛，X线片检查显示髓腔内有阻射的钙化物或呈弥漫性阻射影像导致原髓腔的透射区消失。掌握“乳牙牙髓病及根尖周病诊断及治疗”知识点。